尺骨叙述错误的是
A. 尺骨头朝向下方
B. 参与桡腕关节的构成
C. 与桡骨之间有骨间膜相连
D. 前臂旋转时保持不动
E. 尺骨颈易骨折

正确答案：B。参与桡腕关节的构成

解析：桡腕关节由手的舟骨、月骨和三角骨的近侧关节面作为关节头，桡骨的腕关节面和尺骨头下方的关节盘作为关节窝而构成 （B错，为本题正确答案）。尺骨头朝向下方（A对）。尺骨与桡骨之间有骨间膜相连（C对）。前臂旋转时尺骨保持不动（D对）。